广西某县城居民以玉米为主食，2009年秋天突然有10余人患肝病，表现为发热、呕吐、厌食、黄疸，以后出现腹水、水肿，幸好抢救及时，未发生死亡。经医师诊断排除传染性肝炎，分析原因最可能是
A. 玉米中有农药残留
B. 玉米被黄曲霉毒素（AF）污染
C. 污水灌田引起玉米中镉超标
D. 玉米晾晒过程被多环芳烃污染
E. 玉米中混进了有毒植物种子

正确答案：B。玉米被黄曲霉毒素（AF）污染